仅限于可见唇红黏膜原发的癌是
A. 唇癌
B. 颊黏膜癌
C. 皮肤癌
D. 口底癌
E. 中央性颌骨癌

正确答案：A。唇癌

解析：唇癌应仅限于可见唇红黏膜原发的癌。掌握“颊癌、口底癌及唇癌”知识点。